风寒感冒颗粒的适应病症有
A. 发热头痛
B. 恶寒无汗
C. 咽喉肿痛
D. 咳吐黄痰
E. 鼻塞流清涕

正确答案：A、B、E。发热头痛；恶寒无汗；鼻塞流清涕